具有麻醉药品和第一类精神药品处方资格的执业医师，未按照临床应用指导原则的要求使用麻醉药品造成严重后果的，处以
A. 警告、暂停执业活动
B. 吊销印鉴卡
C. 吊销执业证书
D. 处1万元以上罚款
E. 降级，撤职，开除

正确答案：C。吊销执业证书

解析：具有麻醉药品和第一类精神药品处方资格的执业医师，未按照临床应用指导原则的要求使用麻醉药品造成严重后果的，由原发证部门吊销其执业证书。掌握“麻醉、精神药品的使用及法律责任”知识点。